由茯苓、枳壳、半夏、风化朴硝组成的方剂是
A. 定痫丸
B. 大陷胸汤
C. 茯苓丸
D. 小陷胸汤
E. 半夏泻心汤

正确答案：C。茯苓丸

解析：本题考查方剂的组成，茯苓丸组成茯苓、枳壳、半夏、风化朴硝（C对）。定痫丸组成明天麻、川贝母、半夏、茯苓、茯神、胆南星、石菖蒲、全蝎、僵蚕、真琥珀、陈皮、远志、丹参、麦冬、辰砂（A错）。大陷胸汤组成大黄、芒硝、甘遂（B错）。小陷胸汤组成黄连、半夏、瓜蒌实（D错）。半夏泻心汤组成半夏、黄芩、干姜、人参、黄连、大枣、甘草（E错）。